正常情况下咀嚼肌肌力闭合道的终点是
A. 正中关系位
B. 下颌姿势位
C. 后退接触位
D. 牙尖交错位
E. 铰链位

正确答案：D。牙尖交错位

解析：本题考查颌位。正常情况下咀嚼肌肌力闭合道的终点是牙尖交错位（D对）。下颌姿势位（MPP）与牙尖交错位（ICP）之间主要表现为垂直方向的关系。从MPP开始，下颌向上运动1～3mm，并略向前移动，即达到ICP。当开口后再闭口时，下颌随升颌肌作用的方向而运动，其运动轨迹被称为肌力闭合道。正常情况下,肌力闭合道的终点与ICP一致。正中关系位（A错）：正中关系（CR）是指下颌适居正中，在适当的面部距离（垂直距离），髁突处于关节窝中的前、上位，关节盘-髁突复合体抵住关节结节后斜面时的一种下颌位置关系，此时髁突对上颌的位置关系称为正中关系位（CRP）。下颌姿势位（B错）：当人直立或端坐，两眼平视前方，不咀嚼、不吞咽、不说话时，提颌肌群轻微收缩以对抗下颌骨所承受的重力，上下颌牙之间有一前大后小的楔形间隙，约2～4mm称为息止（牙合）间隙，此时下颌所处的位置称为下颌姿势位。后退接触位（C错）：从牙尖交错位（ICP）开始，下颌可以向后下移动少许（约1mm），后牙牙尖斜面保持部分接触，受颞下颌韧带的限制，下颌不能再向后退，是下颌的生理性最后位，下颌的这个位置称为后退接触位（RCP）。